硝酸甘油抗心绞痛的作用机制是
A. 增加心肌供氧量
B. 抑制心肌收缩力
C. 收缩外周血管
D. 减慢房室传导
E. 释放NO

正确答案：E。释放NO

解析：硝酸甘油是一氧化氮的供体，硝酸甘油在平滑肌细胞内经谷胱甘肽转移酶的催化释放出NO（E对），NO与其受体结合后使之结构改变而活化，促进血管内的cGMP的生成增加，从而引起生物学效应。硝酸甘油使容量血管扩张而降低前负荷，心室舒张末压力及容量也降低，在较大剂量时也扩张小动脉而降低后负荷（C错），从而降低心肌耗氧量（A错）从而缓解心绞痛。在大剂量应用硝酸甘油的时候，可以反射性的引起交感神经兴奋、心率增加、心肌收缩力加强（B错）。硝酸甘油对房室传导的作用不大（D错）。